贯穿结扎法最适用的是
A. 内痔嵌顿
B. 静脉曲张性外痔
C. 血栓性外痔
D. 赘皮外痔
E. Ⅱ、Ⅲ期内痔疮

正确答案：E。Ⅱ、Ⅲ期内痔疮

解析：贯穿结扎法适用于Ⅱ-Ⅳ期内痔（E对）。吻合器痔上黏膜环切订合术适用于内痔嵌顿（A错）。外痔静脉丛剥离术适用于静脉曲张性外痔（B错）。血栓外痔剥离术适用于血栓性外痔（C错）。外痔切除术适用于结缔组织性外痔，即赘皮外痔（D错）。